对比患有某疾病的患者组与未患此病的对照组，对某种药物的暴露进行回顾性研究，找出两组对该药物的差异，这种研究方法属于
A. 病例对照研究
B. 随机对照研究
C. 队列研究
D. 病例交叉研究
E. 描述性研究

正确答案：A。病例对照研究

解析：本题考查分析流行病学研究方法。对比患有某疾病的患者组与未患此病的对照组，对某种药物的暴露进行回顾性研究，找出两组对该药物的差异，这种研究方法属于病例对照研究（A对）。随机对照研究（B错）是采用随机分配的方法，将合格研究对象分别分配到试验组和对照组，然后接受相应的试验措施，在一致的条件下或环境中，同步地进行研究和观测试验效应，并用客观的效应指标对试验结果进行科学的测量和评价。队列研究（C错）又称定群研究，是将样本分为两个组，一组为暴露于某一药物的患者，与另一组不暴露于该药物的患者进行对比观察，验证其结果的差异，如不良事件的发生率或疗效。队列研究可以是前瞻性研究，也可以是回顾性研究。病例交叉研究（D错）的定义是：选择发生某种急性事件的病例，分别调查事件发生时及事件发生前的暴露情况及程度，来判断暴露危险因素与某事件有无关联及其关联程度大小的研究方法。描述性研究（E错）是指利用常规检测记录或通过专门调查获得的数据资料（包括实验室检查结果），按不同地区、不同时间及不同人群特征进行分组，描述人群中有关疾病或健康状态以及有关特征和暴露因素的分布状况，在此基础上进行比较分析，获得疾病三间(人群、地区、时间）分布的特征，进而获得病因线索，提出病因假设和线索。